突触后膜对哪些离子通透性增加引起抑制性突触后电位
A. K⁺、Cl⁻，尤其是K⁺
B. Na⁺、Cl⁻，尤其是Na⁺
C. K⁺、Cl⁻，尤其是Cl⁻
D. Ca²⁺、Cl⁻，尤其是Ca²⁺
E. Na⁺、Cl⁻，尤其是Cl⁻

正确答案：C。K⁺、Cl⁻，尤其是Cl⁻